颅顶部外伤易形成硬膜外血肿的原因
A. 硬脑膜无收缩力
B. 硬脑膜与颅骨之间存在硬膜外隙
C. 颅顶部血供丰富
D. 硬脑膜与颅顶骨结合疏松
E. 颅顶骨内有板障静脉

正确答案：D。硬脑膜与颅顶骨结合疏松

解析：硬脑膜与颅顶骨结合疏松（D对），当颅顶部外伤导致硬脑膜血管损伤时，易在此连接疏松处形成硬膜外血肿。